健康促进学校的目标人群主要是
A. 学生
B. 教职员工
C. 学校领导
D. 学生家长
E. 社区人群

正确答案：A。学生